牙本质具有渗透性的生理基础是以下哪项
A. 球状牙本质
B. 修复性牙本质
C. 牙本质液
D. 牙本质小管
E. 釉牙本质界

正确答案：D。牙本质小管

解析：牙本质具有小管使其具有渗透性。掌握“牙本质”知识点。